设置社区卫生服务机构，由哪一级政府卫生行政部门审批
A. 县级
B. 地市级
C. 乡级
D. 省级
E. 中央

正确答案：B。地市级